有关乳牙龋病的预防，哪一项是正确的
A. 龋病预防工作，应有家长参与完成
B. 出生6个月后，即应诱导幼儿刷牙
C. 饮食管理主要是进软甜食后要刷牙
D. 氟化亚锡和氟化银可作预防药物使用
E. 3岁以后使用含氟牙膏防龋

正确答案：A。龋病预防工作，应有家长参与完成

解析：幼儿期龋病预防工作应该由口腔医生、家长和幼儿园老师共同努力才能取得良好效果。口腔医生应有意识地指导家长，使家长了解儿童阶段牙齿的特点及重要性；了解有关龋病的知识，掌握口腔卫生保健的知识和清洁的方法；认真配合医生定期进行口腔检查。幼儿园老师与家长要重视儿童的口腔卫生，培养他们养成正确的口腔卫生习惯和饮食习惯，培养儿童学会刷牙和餐后漱口，教育他们少吃零食和甜食，纠正偏食和单侧咀嚼等不良习惯。儿童年龄太小，吞咽反射尚未完全建立，经常使用含氟牙膏并吞咽过量的氟，有可能引起某些牙的很轻度氟牙症。在饮水氟含量过高，有地氟病流行的地区，6岁以下的儿童不推荐使用含氟牙膏。硝酸银、氟化氨银均有腐蚀性。掌握“年轻恒牙龋”知识点。